颌骨骨折的重要治愈标准是
A. 骨性愈合
B. 纤维性愈合
C. 骨折线上的牙齿不松动
D. 恢复原有咬合关系
E. 无感染发生

正确答案：D。恢复原有咬合关系

解析：本题考查颌骨骨折的重要治愈标准。骨折治疗要兼顾形态与功能，既要恢复颌骨解剖形态，还要恢复原有咬合关系（D对），恢复咀嚼功能。这是颌骨骨折正确复位的“金标准”。纤维性愈合（B错）和骨性愈合（A错）是骨折愈合过程中的不同组织学阶段。骨折线上的牙应尽量保存，但如骨折线上的牙已松动、折断、龋坏、牙根暴露过多或有炎症时，无保留意义，应予拔除（C错）。无感染发生有利于创口愈合，但不是其治愈标准（E错）。